舌神经阻滞麻醉时不会出现
A. 舌体烧灼感
B. 舌体肿胀感
C. 舌体麻木感
D. 颊侧麻木
E. 一般舌神经出现麻醉征象较下牙槽神经为早

正确答案：D。颊侧麻木

解析：舌神经阻滞麻醉效果：同侧舌有烧灼、肿胀、麻木感，尤以舌尖部更为明显，同时行下牙槽神经麻醉者，一般舌神经出现麻醉征象较下牙槽神经为早。掌握“颌面部常用局麻法及牙拔除的麻醉选择”知识点。